关于膈的描述，何者错误
A. 心包与膈中心腱贴连
B. 右侧膈穹窿较高，平第四肋
C. 腔静脉孔平第八胸椎，位于膈腱性部
D. 食管裂孔约平第十胸椎，位于膈腱性部
E. 膈脚起自上2-3个腰椎

正确答案：B。右侧膈穹窿较高，平第四肋

解析：心包与膈中心腱贴连（A对）。右侧膈穹窿较高，平第五肋间隙，而非第四肋（B错，为本题正确答案）。膈的腔静脉孔平第八胸椎，位于膈腱性部（C对），食管裂孔约平第十胸椎，位于膈腱性部（D对），膈脚起自上2-3个腰椎（E对）。